根据《药品经营质量管理规范》，对一类精神药品应
A. 质量审核
B. 专柜存放
C. 定期养护
D. 分开设置
E. 逐批验收

正确答案：B。专柜存放